用寒远寒的用药原则为
A. 因地制宜
B. 因人制宜
C. 扶正祛邪
D. 调整阴阳
E. 因时制宜

正确答案：E。因时制宜

解析：本题考查的是因时制宜的原则和临床应用。用寒远寒的用药原则为因时制宜（E对）。因时制宜，是指根据不同季节气候特点，来考虑治疗用药的原则。四时气候的变化，对人体的生理功能、病理变化均产生一定的影响。1.用温远温：前者之“温”，指药性之温；后者之“温”，指气候之温；“远”，即避之、避免之意。下文仿此。春季，气候由温渐热，阳气升发，应避免过用辛温发散药物，以免发泄太过。2.用热远热：夏季，气候炎热，人体腠理疏松，阳气偏盛，应避免过用热性药物，以免耗伤气阴。3.用凉远凉：秋季，阴长阳消，气候转凉，人体腠理致密，避免过用凉性药物，以免伤及阳气。4.用寒远寒：冬季，气候由凉变寒，阴盛阳衰，阳气内敛，应避免过用寒性药物，以防伤阳。因地制宜（A错）：根据不同地域的地理特点，来考虑治疗用药的原则，即为“因地制宜”。因人制宜（B错）：根据患者年龄、性别、体质、生活习惯等不同特点，来考虑治疗用药的原则，叫做“因人制宜”。扶正祛邪（C错）：所谓扶正，即是扶助正气、增强体质、提高机体抗邪能力。所谓祛邪，即是祛除病邪，使邪去正安。调整阴阳（D错）为临床治疗的根本法则之一。疾病的发生，其根本即是阴阳的相对平衡遭到破坏，出现偏盛偏衰的结果。因此，调整阴阳，使之恢复平衡，促进阴平阳秘，也是临床治疗的根本法则之一。